男性，56岁，糖尿病患者，血糖控制欠佳，颌面部手术后颏下区大面积感染，经2周换药后遗留5cm×3cm的感染肉芽创面，此时植皮宜选用
A. 表层皮片
B. 薄中厚皮片
C. 厚中厚皮片
D. 全厚皮片
E. 保存真皮下血管网全厚皮片

正确答案：A。表层皮片

解析：刃厚皮片也称表层皮片。游离皮片移植适用于大面积的浅层组织，包括皮肤和黏膜的缺损。一般说来，面颈部植皮应多采用全厚或厚中厚皮片；口腔内植皮，一般多采用薄中厚皮片；有感染的肉芽创面或骨面，则只能采用刃厚皮片移植。全厚皮片因含有毛囊，移植后毛发可以再生，故也可用于眉再造等手术。掌握“皮片移植”知识点。